男婴，8个月，自幼人工喂养，未补充维生素D制剂，近来出现多汗、烦躁、夜惊，查体：方颅，出牙延迟，串珠，诊断为佝偻病活动期，发病机制下列哪项是错误的
A. 尿磷排出增加
B. 血中钙磷乘积降低
C. 维生素D缺乏
D. 钙磷肠道吸收减少
E. 甲状腺代偿功能不足

正确答案：E。甲状腺代偿功能不足

解析：由题干可知该患儿因人工喂养时未补充维生素D制剂（C对）处于佝偻病活动期，故可有方颅、佝偻病串珠等临床表现，其实验室检查可有低血磷、低钙，尿磷排出增加（A对），故血中钙磷乘积降低（B对），维生素D缺乏可引起钙磷肠道吸收减少（D对）及甲状旁腺素增加，故甲状腺代偿功能增加（E错，为本题正确答案）。